口腔的前界为
A. 上下颌骨
B. 上下牙齿
C. 上下唇
D. 上腭
E. 舌下区

正确答案：C。上下唇

解析：口腔境界：口腔前界为上下唇，后经由腭垂、腭舌弓和舌根共同组成的咽口通向口咽部，两侧为颊，上界为腭，下以舌下区为界。掌握“口腔境界及唇、颊的局部解剖”知识点。